男，25岁，高热1周，头痛呕吐2天，血常规Hb87g/L，WBC33.5×10⁹/L，Plt30×10⁹/L，骨髄细胞学检查见分类不明的原始、幼稚细胞占0.82，为鉴别该细胞的来源，目前最准确的检查技术是
A. 细胞非特异性脂酶染色
B. 细胞糖原染色
C. 流式细胞术检查
D. 染色体检查
E. 细胞髓过氧化物酶染色

正确答案：D。染色体检查

解析：患者青年男性，高热1周，头疼，呕吐，骨髄细胞学检查见分类不明的原始、幼稚细胞占0.82（白血病表现），诊断为急性白血病，为鉴别该细胞的来源（淋系和髓系），目前最准确的检查技术是染色体检查（D对） 。细胞髓过氧化物酶染色（E错）无法区分：急淋（-），急性髓系（-）或（+）。流式细胞术检查（C错）是根据细胞表面标记不同，使用相应抗体将细胞分类，即免疫分型，用于形态学，细胞化学染色不能肯定细胞来源的白血病，并不作为首选。